既是络穴，又是八脉交会穴的是
A. 足三里
B. 尺泽
C. 外关
D. 悬钟
E. 曲池

正确答案：C。外关

解析：外关在手少阳三焦经，在前臂后区，腕背侧远端横纹上2寸，尺骨与桡骨间隙中点，既是络穴，又是八脉交会穴（C对）。足三里是合穴，胃经下合穴（A错）；尺泽是合穴（B错）；悬钟是八会穴之髓会（D错）；曲池是合穴（E错）。